某地区为调查中、小学生近视率以及在不同年级城乡中的分布状况，在全区60所中、小学中进行抽样调查。较合理的抽样方法是
A. 采用整群抽样的方法
B. 采用分层抽样的方法
C. 先整群抽样，再分层抽样
D. 先分层抽样，再整群抽样
E. 先整群分组，再随机抽样

正确答案：D。先分层抽样，再整群抽样

解析：本题考查抽样方法的选择。分层抽样是从一个可以分成不同子总体（或称为层）的总体中，按规定的比例从不同层中随机抽取样品（个体）的方法。整群抽样是指整群地抽选样本单位，对被抽选的各群进行全面调查的一种抽样组织方式。本题调查中、小学生近视率以及在不同年级城乡中的分布状况，应先分层抽样，再整群抽样（D对ABCE错）。